在假设检验中为了减小犯Ⅱ型错误的概率，应
A. 严格做到均衡
B. 保留有效数字更多位数
C. 减小犯Ⅰ型错误的概率
D. 增加样本量
E. 更好随机抽样

正确答案：D。增加样本量

解析：假设检验中为了减小犯Ⅱ型错误的概率可以通过增加样本量的方法实现（D对）。